目前中国已经形成了一个以“一法两纲”为核心的妇女保健政策法律体系，其中的一法指的是
A. 《中华人民共和国母婴保健法》
B. 《中华人民共和国妇女权益保障法》
C. 《中华人民共和国人口与计划生育法》
D. 《孕产期保健工作管理办法》
E. 《女职工劳动保护特别规定》

正确答案：A。《中华人民共和国母婴保健法》

解析：本题考查妇女保健政策法律体系。目前中国已经形成了一个以“一法两纲”为核心的妇女保健政策法律体系，其中的一法指的是《中华人民共和国母婴保健法》（A对BCDE错），两纲指的是《中国儿童发展纲要》和《中国妇女发展纲要》。